最容易引起窦房传导阻滞的是
A. 高钾血症
B. 饮茶
C. 甲状腺功能亢进症
D. 交感神经张力过高
E. 贫血

正确答案：A。高钾血症

解析：窦房传导阻滞（SAB）简称窦房阻滞，指窦房结冲动传导至心房时发生延缓或阻滞。可见于器质性心脏病患者、高钾血症（A对）、药物中毒、大剂量使用普罗帕酮、迷走神经张力增高（D错）、颈动脉窦过敏的健康人。但最容易引起传导阻滞的是高钾血症。窦性心动过速（P182）可见于健康人吸烟、饮茶（B错）、体力活动及情绪激动时，也可见于某些病理状态，如发热、甲状腺功能亢进症（C错）、贫血（E错）、休克、心肌缺血等。